医务人员应共同遵守的道德原则以及建立良好医际关系的思想基础是
A. 病人利益至上
B. 医生利益至上
C. 医院利益至上
D. 社会利益至上
E. 以上都不是

正确答案：A。病人利益至上

解析：维护患者的健康和生命，捍卫患者的正当权益，这是医务人员的共同义务和天职，也是协调医务人员之间关系的思想基础和道德要求。掌握“医务人员之间关系伦理”知识点。